最可能为肝硬化腹水的是
A. 腹水比重＜1.016，蛋白=20g/L
B. 腹水比重＞1.018，李凡他（Rivalta）试验阳性
C. 乳糜样腹水
D. 腹水细胞总数＞1000×10⁶/L，分类以中性粒细胞为主
E. 腹水细胞总数为1000×10⁶/L，分类以间皮细胞为主

正确答案：A。腹水比重＜1.016，蛋白=20g/L

解析：肝硬化腹水通常为漏出液。漏出液外观清澈透明，无色或浅黄色、不凝固（C错）；比重＜1.018，李凡他（Rivalta）试验阴性（B错）；蛋白定量＜30g/L（A对）；细胞计数＜100×10⁶／L（D错），以淋巴细胞和间皮细胞为主（E错）（P116）。